椿皮的功效是
A. 涩肠杀虫
B. 敛肺生津
C. 固精止带
D. 益肾固精
E. 敛汗止血

正确答案：A。涩肠杀虫

解析：本题考查的是椿皮的功效。椿皮的功效是涩肠杀虫（A对）。椿皮：【功效】清热燥湿，涩肠，止血，止带，杀虫。乌梅：【功效】敛肺，涩肠，生津（B错），安蛔，止血。海螵蛸：【功效】收敛止血，固精止带（C错），制酸止痛，收湿敛疮。莲子肉：【功效】补脾止泻，益肾固精（D错），止带，养心安神。五倍子：【功效】敛肺降火，涩肠固精，敛汗止血（E错），收湿敛疮。